最常引起血道转移的癌是
A. 甲状腺乳头状癌
B. 肺鳞状细胞癌
C. 乳腺浸润性导管癌
D. 直肠未分化癌
E. 子宫绒毛膜癌

正确答案：E。子宫绒毛膜癌

解析：子宫绒毛膜癌（E对）自身无间质血管，依靠侵袭宿主血管获取营养，除在局部破坏蔓延外，极易经血行转移。甲状腺乳头状癌（P315）（A错）恶性程度较低，生长缓慢，较少转移。肺鳞状细胞癌（B错）多为中央型肺癌，常直接侵犯纵膈、心包及周围血管，淋巴道转移发生较早（P184）。乳腺浸润性导管癌（P305）（C错）最常见的转移途径是淋巴道转移。直肠未分化癌（P213）（D错）常直接蔓延至邻近器官，如前列腺、膀胱及腹膜等处。